关于手的骨间肌，正确的是
A. 第4骨间背侧肌止于小指桡侧
B. 第2骨间掌侧肌止于中指桡侧
C. 伸掌指关节，屈指间关节
D. 第3骨间背侧肌止于第4指桡侧
E. 受尺神经支配

正确答案：E。受尺神经支配

解析：第4骨间背侧肌止于第4指指背腱膜，而非小指桡侧（A错）。第2骨间掌侧肌止于第2指指背腱膜，而非中指桡侧（B错），屈掌指关节，伸指间关节，而非伸掌指关节，屈指间关节（C错），第3骨间背侧肌止于第4指指背腱膜，而非第4指桡侧（D错），受尺神经支配（E对）。